道德是在人们社会生活实践中形成的，由以下内容决定的是
A. 经济基础
B. 文化发展
C. 意识形态
D. 社会进步
E. 科技发展

正确答案：A。经济基础

解析：该题属于记忆类题目。道德是由社会的经济基础决定的（A对）。